下列哪项不是白斑的分型
A. 均质状
B. 颗粒状
C. 萎缩状
D. 疣状
E. 溃疡状

正确答案：C。萎缩状

解析：可根据临床表现不同，分为均质型和非均质型；非均质型又可分为疣状型、溃疡型和颗粒型。掌握“口腔白斑病”知识点。